呕吐吞酸，胸胁胀满，嗳气频作，脘闷食食少。其证候是
A. 食滞胃脘
B. 胃阴虚
C. 肝脾不调
D. 肝胃不和
E. 胃阳虚

正确答案：D。肝胃不和

解析：肝气横逆犯胃，胃气郁滞，则胸胁胀满；胃气上逆而见呕吐、嗳气；肝气犯胃，胃不主受纳，则吞酸嘈杂，不思饮食（D对）。食滞胃肠证指饮食停积胃肠，以脘腹痞胀疼痛、呕泻酸馊腐臭等为主要表现的证候（A错）。胃阴虚证指阴液亏虚，胃失濡润、和降，以胃脘嘈杂，饥不欲食，脘腹痞胀、灼痛等为主要表现的证候（B错）。肝脾不调证指肝失疏泄，脾失健运，以胁肋作痛、情志抑郁、腹胀、便溏等为主要表现的证候（C错）。胃阳虚证指阳气不足，胃失温煦，以胃脘冷痛、喜温喜按，畏冷肢凉为主要表现的虚寒证候（E错）。